形成骨下袋时的牙槽骨吸收形式
A. 水平型骨吸收
B. 垂直型骨吸收
C. 凹坑状吸收
D. 反波浪形骨吸收
E. 弧形骨吸收

正确答案：B。垂直型骨吸收

解析：垂直型吸收：也称角形吸收，指牙槽骨发生垂直方向或斜行的吸收，与牙根面之间形成一定角度的骨缺损，牙槽嵴顶的高度降低不多，而靠近牙根侧的骨吸收较多。垂直型骨吸收大多形成骨下袋，即牙周袋底位于骨嵴顶的根方。骨下袋最常见于邻面，但也可位于颊舌面。骨下袋和骨上袋的炎症、增生和退行性变化都相同，它们的主要区别是软组织壁与牙槽骨的关系和骨破坏的类型。掌握“慢性牙周炎的病因，表现诊断及预后”知识点。